用口服葡萄糖耐量试验诊断糖尿病标准，其2小时血糖应
A. ≥11.1mmol/L
B. ≥12.1mmol/L
C. ≥10.1mmol/L
D. ≥7.8mmol/L
E. ≥7.0mmol/L

正确答案：A。≥11.1mmol/L

解析：当血糖高于正常范围而又未达到诊断糖尿病标准时，须进行口服葡萄糖耐量试验（OGTT）。OGTT2h PG＜7.7mmol/L（139mg/dl）为正常糖耐量；7.8～11.0mmol/L（140～199mg/dl）为IGT（糖耐量异常）；≥11.1mmol/L（200mg/dl）应考虑糖尿病（A对）。